失血性休克为
A. 高阻力型休克
B. 低阻力型休克
C. 两者均有
D. 两者均无
E. 无

正确答案：A。高阻力型休克

解析：失血性休克属于低血容量性休克的一种，低血容量性休克的典型临床表现有外周阻力增高，因此失血性休克为高阻力型休克（A对BCDE错）。